治疗消化性溃疡脾胃虚寒证，应首选
A. 理中丸合黄芪建中汤
B. 一贯煎
C. 化肝煎
D. 失笑散合丹参饮
E. 柴胡疏肝散

正确答案：A。理中丸合黄芪建中汤

解析：黄芪建中汤可温中健脾，和胃止痛，可用来治疗脾胃虚寒证（A对）。一贯煎具有滋阴疏肝功效，主治肝肾阴虚，肝气郁滞证，临床上主要用于治疗慢性肝炎，慢性胃炎（B错）。化肝煎善解肝气之郁，平气逆而散郁火，主要治疗怒气伤肝，气逆动火，胁痛胀满，烦热动血（C错）。失笑散合丹参饮加减可化瘀通络，理气和胃，可用来治疗瘀血停胃证（D错）。柴胡疏肝散可疏肝理气，和胃止痛，可用来治疗肝胃不和证（E错）。